女，34岁。右下臂骨折2小时，予手法复位，管型石膏固定5小时后，患者感觉右手指麻木，肿胀，活动不灵。查体：生命体征平稳，心肺腹未见异常，目前最恰当的处理方法是
A. 脱水
B. 立即手术
C. 止痛
D. 立即松解外固定
E. 扩血管药物治疗

正确答案：D。立即松解外固定

解析：患者青年女性，右下臂骨折2小时，予手法复位，管型石膏固定5小时后，患者感觉右手指麻木，肿胀，活动不灵（石膏绷带固定注意事项）。由于生命体征平稳，心肺腹未见异常，因此目前最恰当的处理方法是立即松解外固定（D对）。由于是由石膏绷带固定引起的，所以需立即松解外固定。而不用立即手术（B错）、扩血管药物治疗（E错）等。